腹腔干的直接分支是
A. 胃短动脉
B. 胃右动脉
C. 肝固有动脉
D. 胆囊动脉
E. 肝总动脉

正确答案：E。肝总动脉

解析：肝总动脉（E对）和胃左动脉、脾动脉为腹腔干的三大直接分支。